出生4～6个月的婴儿需开始补充
A. 铁
B. 钙
C. 脂肪
D. 蛋白质
E. 维生素

正确答案：A。铁